以下可以消除牙周袋的手术是
A. 根向复位翻瓣术
B. 游离龈移植术
C. 牙龈成形术
D. 侧向复位翻瓣术
E. 系带成形术

正确答案：A。根向复位翻瓣术

解析：根向复位翻瓣术，在龈缘处作内斜切口，尽可能保留角化龈，必须做双侧垂直切口，翻起全厚瓣，刮治、清创后，将龈瓣向根方推移，复位在刚刚覆盖牙槽嵴顶的水平，选用悬吊缝合，加以缝合固定。可增宽附着龈，并能避免牙槽嵴的吸收。适用于牙周袋底超过膜龈联合界者，以及因根分叉病变需暴露根分叉而角化龈过窄者。掌握“慢性牙周炎的治疗原则、程序及方法”知识点。